不属于大骨节病病因的是
A. 环境硒水平过低
B. 真菌毒素污染玉米
C. 饮用水有机物污染严重
D. 真菌毒素污染小麦
E. 环境放射性物质污染

正确答案：E。环境放射性物质污染

解析：本题考查大骨节病的病因。大骨节病是一种地方性、慢性骨关节变形性疾病，以四肢关节软骨和骺板软骨变性坏死、增生、修复为主要病理改变，以骨关节增粗、畸形、强直、肌肉萎缩、运动障碍为主要临床表现。其病因有：1.环境硒水平过低（A对）；2.饮水中有机物中毒：饮水有机物污染（C对）是大骨节病可能原因；3.真菌毒素中毒：大骨节病病区粮食易被镰刀菌污染，可产生某些对机体有害的毒素，如小麦（D对）、玉米（B对）最容易被镰刀菌污染。环境放射性物质污染（E错，为本题正确答案）不属于大骨节病的病因。